根据《最高人民法院、最高人民检察院关于办理危害药品分定刑事案件适用法律若干问题的解释》，在生产、销售假药的刑事案件中，下列情形不属于“酌情从重处罚”的是
A. 生产的假药属于疫苗的
B. 生产的假药属于注射剂的
C. 医疗机构工作人员销售假药的
D. 药品检验机构工作人员销售假药的

正确答案：D。药品检验机构工作人员销售假药的

解析：本题考查生成、销售、使用假药的刑事责任。根据《最高人民法院、最高人民检察院关于办理危害药品分定刑事案件适用法律若干问题的解释》，在生产、销售假药的刑事案件中，下列情形不属于“酌情从重处罚”的是药品检验机构工作人员销售假药的（D错，为本题正确答案）。在刑罚的适用中，根据《刑法》第一百五十条规定，单位犯生产、销售假药罪的，对单位判处罚金，并对其直接负责的主管人员和其他直接责任人员，依照自然人犯生产、销售假药罪的定罪量刑标准处罚。根据《最高人民法院、最高人民检察院关于办理危害药品安全刑事案件适用法律若干问题的解释》第一条规定，生产、销售、提供假药，具有下列情形之一的，应当酌情从重处罚：①生产、销售的假药以孕产妇、婴幼儿、儿童或者危重病人为主要使用对象的；②生产、销售的假药属于麻醉药品、精神药品、医疗用毒性药品、放射性药品、避孕药品、血液制品、疫苗的（A对）；③生产、销售的假药属于注射剂药品、急救药品的（B对）；④医疗机构、医疗机构工作人员生产、销售假药的（C对）；⑤在自然灾害、事故灾难、公共卫生事件、社会安全事件等突发事件期间，生产、销售用于应对突发事件的假药的；⑥两年内曾因危害药品安全违法犯罪活动受过行政处罚或者刑事处罚的；⑦其他应当酌情从重处罚的情形。在自然灾害、事故灾难、公共卫生事件、社会安全事件等突发事件发生时期，生产、销售用于应对突发事件药品的假药的，依法从重处罚。